以下关于金属高嵌体的说法中不确切的是
A. 可用作咬合面重建
B. 可用于保护薄弱牙尖
C. 常用箱形、钉洞固位
D. 可用于前后牙
E. （牙合）面至少应预备1.0mm

正确答案：D。可用于前后牙

解析：本题考查金属嵌体。关于金属高嵌体的说法中不确切的是可用于前后牙（D错，为本题正确答案）。后牙的多面嵌体，特别是前磨牙采用嵌体形式往往牙折风险较大，因此更多采用高嵌体形式。可用于保护薄弱牙尖（B对）、咬合面重建（A对）。高嵌体的固位主要靠钉洞固位。在（牙合）面作牙体预备时，如（牙合）面与对颌牙有接触关系，应沿（牙合）面外形均匀降低患牙（牙合）面，预备出至少1.0mm的间隙（E对），并使嵌体（牙合）面包括牙体（牙合）面边缘及工作牙尖。如（牙合）面已是低（牙合），则应稍加修整，去除过锐尖嵴即可。磨牙常采用4个钉洞固位，如有局部缺损，也用小箱状固位形（C对）。钉洞分散于近远中窝及颊舌沟内，深度超过釉牙本质界，一般为2mm，直径为1mm。预备时沿牙长轴方向进行，钉洞之间必须相互平行，为此可采用带平行控制仪的弯机。在完成第一个钉洞之后，以此为准，依靠平行控制仪掌握钉洞的方向，熟练者可凭目测控制钉洞的方向。